挥发油的化学常数有酸值、酯值和皂化值，实际只要测定
A. 酸值、酯值
B. 酸值、皂化值
C. 酯值、皂化值
D. 酸值、酯值、皂化值
E. 皂化值

正确答案：A。酸值、酯值

解析：本题考查的是挥发油的化学常数。挥发油的化学常数有酸值、酯值和皂化值，实际只要测定酸值、酯值（A对）。挥发油的化学常数：酸值、酯值和皂化值是不同来源挥发油所具有的重要化学常数，也是衡量其质量的重要指标。1.酸值：是代表挥发油中游离羧酸和酚类成分含量的指标。以中和1g挥发油中游离酸性成分所消耗氢氧化钾的毫克数表示。2.酯值：是代表挥发油中酯类成分含量的指标。以水解1g挥发油中所含酯需消耗氢氧化钾的毫克数表示。3.皂化值：是代表挥发油中游离羧酸、酚类成分和结合态酯总量的指标。以皂化1g挥发油所消耗氢氧化钾的毫克数表示。皂化值是酸值和酯值之和。